用速率法测定血清丙氨酸氨基转移酶（ALT）时，其正常值参考范围是
A. <30U/L
B. <40U/L
C. <50U/L
D. <60U/L
E. <80U/L

正确答案：B。<40U/L

解析：本题考查肝功能检查。用速率法测定血清丙氨酸氨基转移酶（ALT）和天门冬氨酸氨基转移酶（AST）时，其正常值参考范围是＜40U/L（B对）。